属于ACEI类降压药的是
A. 贝那普利
B. 硝酸甘油
C. 地高辛
D. 美托洛尔
E. 地尔硫䓬

正确答案：A。贝那普利

解析：ACEI类降压药还包括贝那普利（A对）、卡托普利、依那普利等。硝酸甘油（B错）属于血管平滑肌扩张类降压药。美托洛尔（D错）属于β受体阻滞剂类降压药，地尔硫䓬（E错）属于钙通道受体阻滞剂类降压药。地高辛（C错）属于正性肌力药，不属于降压药。